卫生服务综合评价指标的筛选原则是
A. 重要性、实用性、有效性、特异性、敏感性、代表性、可行性、可及性
B. 重要性、实用性、有效性、特异性、敏感性、可信性、可行性、可及性
C. 重要性、实用性、有效性、特异性、敏感性、可信性、可靠性、可及性
D. 重要性、实用性、有效性、特异性、敏感性、代表性、可靠性、可及性

正确答案：D。重要性、实用性、有效性、特异性、敏感性、代表性、可靠性、可及性

解析：本题考查卫生服务综合评价指标的筛选原则。卫生服务综合评价指标的筛选原则是：重要性、实用性、有效性、特异性、敏感性、代表性、可靠性、可及性（D对ABC错）。